以下不是公共卫生工作的主要特点的是
A. 价值导向的超前性，服务对象的整体性，研究方法的独特性
B. 工作效率的紧迫性、时效性，工作过程的长期性和艰巨性
C. 工作效果评价的滞后性、效益影像的深远性
D. 社会效益、经济效益的可观性
E. 以上均不是

正确答案：D。社会效益、经济效益的可观性